患者，女，26岁。阴部瘙痒2天，坐卧不安，带下量多，色黄质稠，其气臭秽，心烦少寐，口苦而腻，舌苔黄腻，脉弦数。其证候是
A. 血热
B. 湿毒
C. 肝经湿热
D. 痰湿
E. 脾虚夹湿

正确答案：C。肝经湿热

解析：患者带下量多，阴部瘙痒，色黄质稠，其气臭秽，是因为湿热蕴结于下，损伤任带二脉；肝经湿热内盛，阻于中焦，故心烦少寐，口苦而腻；舌苔黄腻，脉弦数为湿热之征（C对）。血热证以身热口渴，斑疹吐衄，烦躁谵语，舌绛，脉数等为主要表现的实热证候（A错）。湿毒证以身体困重、肢体酸痛、腹胀腹泻等为主要表现的证候（B错）。痰湿证以咳嗽痰多、胸闷、呕恶、眩晕、体胖等为主要表现的证候（D错）。脾虚夹湿证以纳呆、腹胀、便溏、身重与寒湿症状为主要表现的证候（E错）。